某颜料制造厂男工，工龄10年，因血尿入院，怀疑是膀胱癌。采集职业史时应注意询问何种生产性毒物的接触史
A. 铬酸盐
B. 苯
C. 氯乙烯
D. 联苯胺
E. 氯甲醚

正确答案：D。联苯胺

解析：本题考查膀胱癌的诱发因素。联苯胺（D对ABCE错）是一种白色或淡红色的粉状或片状晶体，可以与亚硝酸发生重氮化反应生成重氮盐，此盐与芳香胺或酚偶联可得到多种联苯胺染料。联苯胺及其盐类可经呼吸道、胃肠道、皮肤进入人体，从而在膀胱蓄积导致膀胱癌。题中工人工作于颜料厂，有大量接触联苯胺的机会，是诱发膀胱癌的重要因素。